手术器械、医用胶片、牙科座椅，属于医疗器械产品的
A. 第一类
B. 第二类
C. 第三类
D. 第四类
E. 第五类

正确答案：B。第二类